皮质脊髓前束
A. 主要由交叉的纤维组成
B. 其纤维向下终止于对侧前角
C. 管理对侧骨骼肌(包括下肢)的随意运动
D. 其细胞体位于中央前回下1/3的皮质内
E. 它属于下运动神经元

正确答案：B。其纤维向下终止于对侧前角

解析：皮质脊髓前束是皮质脊髓束的分支之一，由中央前回上、中部和中央旁小叶前半部等处皮质的锥体细胞轴突集中而成（D错）。皮质脊髓束中小部分未交叉的纤维在同侧脊髓前索内下行，称皮质脊髓前束（A错），属于上运动神经元（E错），其在终止前经白质前连合逐节交叉至对侧，止于对侧前角运动神经元（B对）。躯干肌是受两侧大脑皮质支配（C错）。